关于代谢性酸中毒，正确的论述是
A. 血管对儿茶酚胺的反应性持续升高
B. 脑组织γ-氨基丁酸生成减少
C. 常常导致低钾血症
D. 可产生心律失常、心肌收缩力下降
E. 中枢神经系统兴奋性增高

正确答案：D。可产生心律失常、心肌收缩力下降

解析：发生代谢性酸中毒，细胞外的H+向细胞内移动，细胞内k+向细胞外转移，常常导致高钾血症（C错），高钾导致严重的传导阻滞和心室纤维性颤动，心肌兴奋性消失，可产生心律失常，同时由于H+影响心肌细胞对Ca的利用使心肌收缩力下降（D对），代谢性酸中毒还可引起血管对儿茶酚胺的反应性持续降低（A错），血管舒张。代谢性酸中毒对中枢神经系统有抑制作用，表现为中枢神经系统兴奋性降低（E错），其可能的一个机制是脑组织γ-氨基丁酸生成增多（B错）。